足月生产，4个月以内的新生儿适合的喂养方式
A. 纯母乳喂养
B. 配方奶喂养
C. 母乳+配方奶
D. 母乳+泥状食物
E. 配方奶+泥状食物

正确答案：A。纯母乳喂养